对明确支气管扩张咯血患者出血部位最有价值的检查是
A. 支气管动脉造影
B. 胸部CT
C. 肺动脉造影
D. 支气管镜
E. 胸部X线片

正确答案：A。支气管动脉造影

解析：支气管动脉造影术对咯血有较好的诊治效果，为明确支扩咯血患者出血部位最有价值的检查。支气管动脉造影明确出血部位，支气管镜不能查细末支气管（A对）。纤维支气管镜可达到3级支气管，可窥见4级支气管，而支扩病变一般都发生于较远的支气管，故经纤支镜直接窥见支扩病变概率不高（D错）。胸部CT（HRCT）（B错）有无创、易重复、易接受的特点，为支气管扩张的主要诊断方法，但不能明确出血部位。肺动脉造影（C错）主要用于肺内血管性疾病的诊断或术前了解肺内血管状况，肺部疾病大咯血患者术前确定出血部位。胸部X线片（E错）对判断有无支气管扩张缺乏特异性，对明确支气管扩张咯血出血部位亦无明显价值。